下列哪项不属于交通意外健康教育与健康促进内容
A. 驾车不超速
B. 严禁酒后驾车
C. 驾车使用免提电话
D. 驾驶摩托车需佩戴头盔
E. 正确使用安全带和儿童安全座椅

正确答案：C。驾车使用免提电话